微波辐射连续波平均功率密度容许接触限值为
A. 0.025μW/cm²
B. 0.05μW/cm²
C. 0.025mW/cm²
D. 50μW/cm²
E. 0.05mW/cm²

正确答案：D。50μW/cm²